某医院收治一名因肺炎入院的产妇李某，医务人员诊断后提出的治疗方案是实施手术缓解肺炎导致的呼吸困难症状，但是其丈夫肖某拒绝剖宫产手术签字，此时该院医务人员选择的伦理决策不正确的是
A. 不进行手术，避免责任风险
B. 优先考虑患者的生命健康权利
C. 勇于承担风险，发挥特殊干涉权
D. 尽可能将患者利益、社会利益置于首位
E. 而将自身利益置于其后

正确答案：A。不进行手术，避免责任风险

解析：在当今价值取向多元化，道德追求现实化的市场经济条件下，医疗中行为主体间的利益冲突的存在是一种客观必然，但对理想道德目标的追求依然应作为行动的统领及引导,虽不是作为判断道德是非的唯一标准，社会应当尊重差异、包容多样的基础上减小利益冲突，寻求双赢结果。但是，上述案例中，医务人员履行了治疗患方知情同意的法律要求，但患者及其未出生的孩子的生命可能会失去，这一结果会影响社会对医学职业的信任及其自身的声誉和医务人员的身心健康。伦理上的知情同意要求医务人员优先考虑患者的生命健康权利，当患者或其家属的知情选择对其生命健康不利，危及患者的生命安危时，医务人员需要勇于承担风险，充分发挥医务人员的特殊干涉权，竭力捍卫患者的生命健康权利。面对利益冲突,需要医务人员有勇于担当的责任意识,尽可能将患者利益、社会利益置于首位，而将自身利益置于其后。掌握“临床治疗的伦理决策”知识点。